严重外伤患者发生脂肪栓塞综合征，该综合征主要累及的部位是
A. 胰
B. 肾
C. 肝
D. 骨
E. 肺

正确答案：E。肺

解析：严重外伤患者发生脂肪栓塞综合征，其机制为：骨折处髓腔内血肿张力过大，骨髓被破坏，脂肪滴进入破裂的静脉窦内，之后依次进入右心房→右心室→肺动脉→造成肺动脉栓塞。直径＜20μm的脂滴栓子，可通过肺毛细血管→肺静脉→左心房→左心室→主动脉→脑动脉→造成脑栓塞。因此脂肪栓塞综合症最易栓塞的部位是肺（E对），其次是脑。胰（A错）、肾（B错）、肝（C错）均可累及，但不是主要累及部位。骨折可引起脂肪栓塞综合症，但其栓塞部位多不在骨（D错）。